具有利气散结，通络止痛功效的药物是
A. 川贝母
B. 天南星
C. 白芥子
D. 天竺黄
E. 桑白皮

正确答案：C。白芥子

解析：白芥子具有温肺化痰，利气散结，通络止痛的功效（C对），可用于寒痰喘咳，悬饮；阴疸流注，肢体麻木，关节肿疡。天南星具有燥湿化痰，祛风解痉的功效；外用可散结消肿（B错）。川贝母具有清热化痰，润肺止咳，散结消肿的功效（A错）。天竺黄具有清热化痰，清心定惊的功效（D错）。桑白皮具有泻肺平喘，利水消肿的功效（E错）。